属于本经配穴的是
A. 头痛取率谷太冲
B. 头痛取头维丰隆
C. 牙痛取合谷内庭
D. 腰痛取命门肾俞
E. 腹泻取天枢尺泽

正确答案：B。头痛取头维丰隆

解析：本经配穴法是当某一脏腑、经脉发生病变时，即选该脏腑、经脉的腧穴配成处方的配穴方法。头维和丰隆均为足阳明胃经腧穴，均可治疗头痛，两穴相配治疗头痛属于本经配穴（B对）。